初产妇，孕37周，8小时前突然出现阴道流液，如小便样，6小时前开始出现规律宫缩，因胎手脱出于阴道口1小时就诊。查体：产妇烦躁不安，腹痛拒按，脉搏110次/分，呼吸28次/分，胎心160次/分，导尿时见血尿。最适宜的处理是
A. 口服地西泮
B. 消毒后还纳肢体
C. 全麻下行内倒转术
D. 立即行剖宫产
E. 等待宫口开全后行牵引术

正确答案：D。立即行剖宫产

解析：该孕妇，孕37周，8小时前突然出现阴道流液，如尿样，因胎手脱出于阴道口1小时就诊（胎位异常者易发生胎盘早破，胎膜早破的患者突感有较多液体从阴道流出，胎盘早破为子宫破裂的病因之一），烦躁不安，腹痛拒按，阴道流血及血尿（先兆子宫破裂会有腹痛，病理缩复环，血尿等表现），故诊断首先考虑为先兆子宫破裂。应立即抑制子宫收缩：肌内注射哌替啶100mg，或静脉全身麻醉并立即行剖宫产（D对）。地西泮（八年制药理学P114）（A错）具有抗焦虑、镇静、催眠、抗惊厥、抗癫痫及中枢性肌肉松弛作用，对此病例效果差，起效慢。先兆子宫破裂易发展成为完全性子宫破裂，导致低血容量休克，易致胎儿死亡，故须立即剖宫产，消毒后还纳肢体（B错）、全麻下行内倒转术（C错）、等待宫口开全后行牵引术（E错）均会耽误救治时间。